龋齿的治疗方法
A. 药物疗法
B. 药物疗法+磨除法
C. 充填术
D. 充填术+药物疗法+磨除法
E. 药物治疗+充填术+拔除术

正确答案：D。充填术+药物疗法+磨除法

解析：本题考查龋病的治疗方法。龋病是以细菌为主要多种因素影响下牙体硬组织发生慢性进行性破坏的一种疾病。根据病变深度分为浅龋、中龋、深龋。用药物疗法治疗浅龋，用磨除术和充填术治疗中龋和深龋，所以龋病的治疗方法为充填术+药物疗法+磨除法（D对ABC错）。龋病可以通过恢复牙齿的美观和功能保留牙齿，因此不能选择拔除术治疗龋病（E错）。